患者，男，57岁，因出现全身酸痛、乏力、高热等症状就诊，经流行病学调查及相关实验室检查，诊断为H₁N₁甲型流感。该患者可选用的神经氨酸酶抑制剂是
A. 金刚烷胺
B. 金刚乙胺
C. 奥司他韦
D. 利巴韦林
E. 阿昔洛韦

正确答案：C。奥司他韦

解析：本题考查流感治疗药。该患者可选用的神经氨酸酶抑制剂是奥司他韦（C对）。神经氨酸酶抑制剂有奥司他韦、扎那米韦等。金刚烷胺（A错）、金刚乙胺（B错）为穿入和脱壳抑制剂。利巴韦林（D错）为广谱抗病毒药。阿昔洛韦（E错）为DNA多聚酶抑制剂。